肺心病发病的主要机制是
A. 肺泡毛细血管急性损伤
B. 支气管肺感染和阻塞
C. 肺弥散功能障碍
D. 肺动脉高压
E. 肺性脑病

正确答案：D。肺动脉高压

解析：肺心病是由支气管-肺组织、胸廓或肺血管病变致肺血管阻力增加，产生肺动脉高压，继而右心室结构或功能改变（D对）。肺泡毛细血管急性损伤（A错）是急性呼吸窘迫综合征的病理表现。支气管肺感染和阻塞（B错）是支气管扩张的发病机制。肺弥散功能障碍（C错）是导致肺换气功能障碍的原因之一。肺性脑病（E错）是肺心病肺、心功能失代偿期的表现，不是发病机制。